当某地空气质量指数（AQI）为110时，该地的空气质量状况为
A. 优
B. 良
C. 轻度污染
D. 中度污染
E. 重度污染

正确答案：C。轻度污染

解析：本题考查空气质量状况。根据《环境空气质量标准》（GB3095-2012），空气质量分为六级，分别为优、良、轻度污染、中度污染、重度污染和严重污染，其中，空气质量指数0～50为优，空气质量指数51～100为良，空气质量指数101～200为轻度污染（C对ABDE错），空气质量指数201～300为中度污染，空气质量指数301～400为重度污染，空气质量指数401～500为严重污染。